女，30岁。停经46天后，下腹部隐痛半月余。然后阴道持续少量出血3天多，右侧附件触及鸡蛋大韧性包块，考虑为
A. 子宫肌瘤
B. 卵巢囊肿
C. 子宫内膜异位症
D. 陈旧性宫外孕
E. 妊娠黄体

正确答案：D。陈旧性宫外孕

解析：输卵管妊娠流产或破裂，若长期反复内出血所形成的盆腔血肿不消散，血肿机化变硬并与周围组织粘连，临床上称陈旧性宫外孕。本例有停经史，所以应考虑与妊娠有关的疾病，故排除ABC；妊娠黄体不是一个疾病名称，也无上述表现，排除E。因为题干中“下腹部隐痛半月余”、“韧性包块”，就表示时间已较长。故选D。掌握“异位妊娠”知识点。